一位初产妇，妊娠39周，产前检查5次，妊娠经过顺利。今晨1时出现阵发性腹痛，不能入睡，坚持到早上8时到当地妇幼保健院就诊，门诊以妊娠足月临产收入院。入院后检查宫缩每5～6分钟一次，持续25～30秒，枕左前位，宫颈口开大2cm，余正常。在这个阶段，以下为产妇提供的保健要点不正确的是
A. 鼓励产妇选择适合自己的舒适体位
B. 鼓励产妇每2～4小时排尿一次
C. 建议尽早剖宫产
D. 鼓励阴道分娩
E. 鼓励产妇按照产妇自己的意愿进食

正确答案：C。建议尽早剖宫产